某农村地区发生3例疑似霍乱病例，这3例疑似病例均从疫区打工回来度假。根据我国传染病防治法规定，责任报告人发现后应在多长时间内向当地卫生防疫机构报告
A. 2小时
B. 3小时
C. 6小时
D. 12小时
E. 24小时

正确答案：A。2小时